龋齿发生的四联因素不包括
A. 致龋细菌
B. 糖类食物
C. 酸性食物
D. 宿主
E. 时间

正确答案：C。酸性食物

解析：本题考查龋齿发生的四联因素。酸性食物（C错，为本题正确答案）不是造成龋齿的四联因素。龋齿发生的四联因素是致龋细菌（A对）、食物、宿主（D对）和时间（E对），其中食物主要指糖类食物（B对），尤其蔗糖是主要致龋食物，不但可酵解产酸，还可通过合成细胞内外多糖的过程，直接参与菌斑的形成。